从月经初潮到生殖器官发育成熟的时期，称为
A. 幼年期
B. 青春期
C. 性成熟期
D. 绝经后期
E. 绝经过渡期

正确答案：B。青春期

解析：月经初潮为青春期的重要标志。掌握“女性生殖系统生理”知识点。